白术与苍术并用的方剂是
A. 健脾丸
B. 完带汤
C. 参苓白术散
D. 藿香正气散
E. 九味羌活汤

正确答案：B。完带汤

解析：该题考查完带汤的组成。完带汤功能补脾疏肝，化湿止带，由白术、山药、人参、白芍、车前子、苍术、甘草、陈皮、黑芥穗、柴胡组成（B对）。趣记：完带趁人少，借苍白山木柴车——完带陈人芍，芥苍白山（木）柴车。